直接参与胆固醇生物合成的物质是
A. NADP+
B. ADP
C. NADPH
D. UTP
E. FAD

正确答案：C。NADPH

解析：直接参与胆固醇生物合成的物质是乙酰CoA、NADPH（C对）和ATP。NADP⁺（A错）、ADP（B错）、UTP（D错）及FAD（E错）均不直接参与胆固醇生物合成。